羊水过多是指
A. 妊娠晚期羊水量少于300ml
B. 任何时期羊水量超过2000ml
C. 足月妊娠时的羊水量为1000ml
D. 足月妊娠时的羊水量为800ml
E. 任何时期羊水量超过1000ml

正确答案：B。任何时期羊水量超过2000ml

解析：羊水过多是指妊娠期间的任何时期羊水量超过2000ml（B对）。妊娠晚期羊水量少于300ml为羊水过少（A错）。